我国对固体废物污染环境的防治内容不包括
A. 鼓励、支持开展清洁生产，减少固体废物的产生量
B. 鼓励、支持综合利用资源，对固体废物实行充分回收和合理利用，并采取有利于固体废物综合利用活动的经济、技术政策和措施
C. 需要进行处理的固体废物，按其性质采取相应控制标准进行处理
D. 禁止中国境外的固体废物进境倾倒、堆放、处置
E. 禁止进口不能用作原料的固体废物，不限进口可以用做原料的固体废物

正确答案：E。禁止进口不能用作原料的固体废物，不限进口可以用做原料的固体废物

解析：本题考查我国对固体废物污染环境的防治内容。我国对固体废物污染环境的防治内容包括：1.鼓励、支持开展清洁生产，减少固体废物的产生量（A对）；2.鼓励、支持综合利用资源，对固体废物实行充分回收和合理利用，并采取有利于固体废物综合利用活动的经济、技术政策和措施（B对）；3.需要进行处理的固体废物，按其性质采取相应控制标准进行处理（C对）；4.禁止中国境外的固体废物进境倾倒、堆放、处置（D对）；5.禁止进口不能用作原料的固体废物，限制进口可以用作原料的废物，确需进口的需经国家环境保护主管部门批准（E错，为本题正确答案）。